关于腹泻的药物治疗的说法，正确的有
A. 有严重腹痛的炎性或血性腹泻患者，应加用洛哌丁胺
B. 应当使用口服补液盐预防和纠正脱水
C. 急性腹泻患者，应常规应用抗感染药物
D. 应当使用蒙脱石散吸附毒素，并增强黏液屏障功能
E. 益生菌应避免与蒙脱石散同时服用

正确答案：B、D、E。应当使用口服补液盐预防和纠正脱水；应当使用蒙脱石散吸附毒素，并增强黏液屏障功能；益生菌应避免与蒙脱石散同时服用

解析：本题考查腹泻的药物治疗。口服补液盐（ORS）Ⅲ比ORSⅡ渗透压低，是腹泻治疗的补液首选，可同时用于预防和纠正脱水（B对）。双八面体蒙脱石散，可覆盖消化道，与黏膜蛋白结合后增强黏液屏障（D对），防止胃酸、病毒、细菌、毒素对消化道黏膜的侵害，首剂可加倍。益生菌的活菌制剂，尽可能避免与抗生素、蒙脱石（E对）、小檗碱和鞣酸蛋白同时应用，以避免效价的降低。对于伴发热或明显腹痛等疑似炎性腹泻以及血性腹泻的患者应避免使用肠道动力抑制剂洛哌丁胺（A错）。急性水样泻患者，排除霍乱后，多为病毒性（如轮状病毒、诺如病毒）或产肠毒素性细菌（如大肠埃希菌）感染，不应常规使用抗感染药物（C错）。